适用于各类高血压，也可用于防治心绞痛的药物是
A. 卡托普利
B. 可乐定
C. 氯沙坦
D. 硝苯地平
E. 哌唑嗪

正确答案：D。硝苯地平

解析：本题考查硝苯地平。硝苯地平（D对）能抑制心肌对钙离子的摄取，使心肌收缩力减弱，降低心肌耗氧量，增加冠脉血流量，还可扩张周边血管，用于治疗冠心病，缓解心绞痛，还可治疗各种类型的高血压。卡托普利（A错）为血管紧张素转化酶抑制剂，用于治疗高血压，心力衰竭，高血压急症。氯沙坦（C错）为血管紧张素Ⅱ受体拮抗剂，用于治疗原发性高血压。可乐定（B错）为α₂受体激动药，用于治疗中、重度高血压。哌唑嗪（E错）为选择性α₁受体阻断剂，能同时扩张阻力血管和容量血管，降低心脏前后负荷，用于治疗顽固性充血性心力衰竭。